患者男性，20岁。初起颜面部红肿热痛，肿势局限，可见一个脓头，3～5日化脓，出脓即愈。应首先考虑的是
A. 疖
B. 痈
C. 疽
D. 丹毒
E. 痰核

正确答案：A。疖

解析：疖的局部症状：初起为毛囊性炎性丘疹，以后炎症向周围扩展，形成红肿热痛之坚硬结节。数日后结节中央变软、有波动感，顶部出现黄白色脓栓，随后脓栓脱落，脓液排出，炎症随之消退而愈，所以诊断为疖（A对）。痈是指多个相邻毛囊及其周围组织的急性化脓性感染。好发于皮肤厚韧的项部和背部（B错）。疽指生长于肌肤间，以局部初起皮肤上即有粟粒脓头，红肿热痛，易向深部及周围扩散，脓头亦相继增多，溃烂后状如莲蓬蜂窝为主要表现的急性化脓性疾病（C错）。无头疽是多种发生在骨骼与关节间的化脓性疾病的统称。丹毒是皮肤淋巴管网的急性感染性疾病。中医亦称之为"丹毒"（D错）。痰核指皮下肿起如核的结块，多由湿痰流聚而成，结块多少不一，不红不肿，不硬不痛，用手触摸，如同果核状软滑而能移动，一般不会化脓溃破（E错）。